具有调节全身阴经经气作用的是
A. 阴跷脉
B. 阴维脉
C. 任脉
D. 冲脉
E. 带脉

正确答案：C。任脉

解析：任脉总任六阴经，调节全身阴经经气，故称“阴脉之海”（C对）。阴跷脉调节下肢运动，司寤寐（A错）。阴维脉维系全身阴经（B错）。冲脉涵蓄十二经气血，故称“十二经之海”，又称“血海”（D错）。带脉约束纵行躯干的诸条经脉（E错）。